婴儿男，出生5天，啼哭拒食，口腔黏膜出现微凸的软白小点，擦去后可露出出血面，拟诊
A. 早萌乳牙
B. 白斑
C. 婴儿雪口病
D. 角化上皮珠
E. 以上都不是

正确答案：C。婴儿雪口病

解析：本题考查口腔念珠菌病。婴儿男，出生5天，啼哭拒食，口腔粘膜出现微凸的软白小点，擦去后可露出出血面，拟诊婴儿雪口病（C对）。该婴儿出生5天，黏膜上有软白小点，啼哭拒食，擦去白点可暴露出血点，患儿的临床表现符合急性假膜型念珠菌口炎（婴儿雪口病）的临床特点。牙胚破龈而出的现象称为出龈，牙冠突破口腔黏膜时会在口腔黏膜上表现为一个白点，此白点实质上是早萌乳牙（A错），该白点无法被擦去。白斑（B错）好发于40岁以上的中老年男性，其所形成的白色损害不能擦去。角化上皮珠（D错）是婴儿出生后不久，偶见牙龈上出现针头大小的白色突起，俗称马牙，一般不影响进食，可自行脱落。